牙髓组织由于营养不良或组织变性，并在此基础上钙盐沉积所形成的大小不等的钙化团块称为
A. 外吸收
B. 内吸收
C. 牙髓坏死
D. 牙髓钙化
E. 牙髓炎

正确答案：D。牙髓钙化

解析：本题考查牙髓变性。牙髓组织由于营养不良或组织变性，并在此基础上钙盐沉积所形成的大小不等的钙化团块称为牙髓钙化（D对）。牙髓钙化：是指牙髓组织由于营养不良或组织变性，并在此基础上钙盐沉积所形成的大小不等的钙化团块。